点隙窝沟龋最有效的预防方法是
A. 向家长宣传点隙窝沟的知识
B. 定期检查，早发现早治疗
C. 控制饮食，睡前刷牙
D. 运用氟化物，含氟牙膏，氟水漱口
E. 点隙窝沟封闭术

正确答案：E。点隙窝沟封闭术

解析：本题考查窝沟封闭。点隙窝沟龋最有效的预防方法是点隙窝沟封闭术（E对）。点隙窝沟易患龋是因为窝沟的存在易导致食物滞留，菌斑形成，特别是一些深而窄的窝沟，难以自我清洁；点隙窝沟封闭术可以封闭深的窝沟，改变窝沟点隙易患龋的解剖特点，是针对其病因最有效的预防方法。向家长宣传点隙窝沟的知识（A错）可以起到预防点隙窝沟龋的作用，但较之窝沟封闭，不是最有效的方法。定期检查，早发现早治疗（B错），控制饮食，睡前刷牙（C错），运用氟化物，含氟牙膏，氟水漱口（D错）都是预防龋病的有效方法，并没有针对点隙窝沟龋的病因，较之窝沟封闭，也不是最有效的方法。